子痫前期（重度），血细胞比容0.41，心率80次/分，血红蛋白110g/L，白蛋白28g/L，血钾、钠、氯正常，选用下列何种扩容剂较好
A. 低分子右旋糖酐
B. 清蛋白
C. 全血
D. 平衡液
E. 5％葡萄糖液

正确答案：B。清蛋白

解析：子痫前期（重度），一般不主张扩容，除非发生低蛋白血症。此患者白蛋白28g/L（正常值35～51g/L），可以明确诊断。故选用B。掌握“娠期高血压疾病”知识点。